为预防伤害，美国一些州规定为儿童设置特殊座，属于
A. 工程策略
B. 教育预防策略
C. 强制执法策略
D. 环境改善策略
E. 评估策略

正确答案：C。强制执法策略

解析：本题考查强制执法策略。为预防伤害，美国一些州规定为儿童设置特殊座，属于强制执法策略（C对ABDE错）。强化执法策略是通过法律和公安部门的措施确保在人群中维持某些行为和规范的实施。